肿势平坦，根盘散漫，其“肿”的成因是
A. 风
B. 火
C. 痰
D. 虚
E. 郁结

正确答案：D。虚

解析：肿势平坦，根盘散漫，属于虚肿，因正虚不能托毒所致（D对）。风肿（A错）见发病急骤，漫肿宣浮，或游走不定，不红微热，或轻微疼痛。热肿（B错）见肿而色红，皮薄光泽，焮热疼痛，肿势急剧。痰肿（C错）见肿势软如棉，或硬如石，大小不一，形态各异，无处不生，不红不热，皮色不变。郁结（E错）见肿势坚硬，表面不平或有棱角，状如岩突，不红不热。